语言发展关键期是
A. 0～1岁
B. 1～3岁
C. 3～7岁
D. 7～11岁
E. 11～13，14岁

正确答案：B。1～3岁